根据《关于禁止商业贿赂行为的暂行规定》，下列说法正确的有
A. 任何单位或者个人在销售或者购买商品时不得收受或者索取贿赂
B. 经营者销售售商品，不得以明示方式给予对方折扣
C. 购货单位或者个人在账外暗中收受回扣的，以受贿论处
D. 在账外暗中给予购货单位或者个人回扣的，以行贿论处
E. 经营者在商品交易中，赠送小额广告礼品的，视为商业贿赂行为

正确答案：A、C、D。任何单位或者个人在销售或者购买商品时不得收受或者索取贿赂；购货单位或者个人在账外暗中收受回扣的，以受贿论处；在账外暗中给予购货单位或者个人回扣的，以行贿论处

解析：本题考查《关于禁止商业贿赂行为的暂行规定》。根据《关于禁止商业贿赂行为的暂行规定》，下列说法正确的有任何单位或者个人在销售或者购买商品时不得收受或者索取贿赂（A对）；购货单位或者个人在账外暗中收受回扣的，以受贿论处（C对）；在账外暗中给予购货单位或者个人回扣的，以行贿论处（D对）。《关于禁止商业贿赂行为的暂行规定》第四条：任何单位或者个人在销售或者购买商品时不得收受或者索取贿赂。第五条：在账外暗中给予对方单位或者个人回扣的，以行贿论处；对方单位或者个人在账外暗中收受回扣的，以受贿论处。本规定所称回扣，是指经营者销售商品时在账外暗中以现金、实物或者其他方式退给对方单位或者个人的一定比例的商品价款。本规定所称账外暗中，是指未在依法设立的反映其生产经营活动或者行政事业经费收支的财务账上按照财务会计制度规定明确如实记载，包括不记入财务账、转入其他财务账或者做假账等。第六条：经营者销售商品，可以以明示方式给予对方折扣（B错）。经营者给予对方折扣的，必须如实入账；经营者或者其他单位接受折扣的，必须如实入账。本规定所称折扣，即商品购销中的让利，是指经营者在销售商品时，以明示并如实入账的方式给予对方的价格优惠，包括支付价款时对价款总额按一定比例即时予以扣除和支付价款总额后再按一定比例予以退还两种形式。本规定所称明示和入账，是指根据合同约定的金额和支付方式，在依法设立的反映其生产经营活动或者行政事业经费收支的财务账上按照财务会计制度规定明确如实记载。第八条：经营者在商品交易中不得向对方单位或者其个人附赠现金或者物品。但按照商业惯例赠送小额广告礼品的除外（E错）。违反前款规定的，视为商业贿赂行为。